RPI卡环采用近中（牙合）支托的主要目的是
A. 防止基托下沉
B. 减少牙槽嵴受力
C. 减少基牙所受扭力
D. 增强义齿稳定
E. 防止食物嵌塞

正确答案：C。减少基牙所受扭力

解析：RPI卡环组近中（牙合）支托：如在游离端牙齿设置远中（牙合）支托，则义齿受力后，基牙常向远中倾斜，而近中（牙合）支托义齿受力后，即使有使基牙向近中倾斜的分力，由于得到近中余留牙的支持，可以保持不动。因此，用近中（牙合）支托可消除或减少基牙所受的扭力。使用远中（牙合）支托时，常产生一类杠杆作用，基托下沉时，卡环臂有向上移动和脱离倒凹区的趋势，对基牙产生扭力。使用近中支托时，则产生二类杠杆作用，基托和卡环同时下沉，卡环和基牙脱离接触，基牙可不受扭力。同时近中支托的小连接体，还有对抗义齿向远中脱位的作用。掌握“局部义齿固位体”知识点。